下列关于脓肿切开引流要求的相关叙述中，不正确的是
A. 切口位置应在脓腔的重力低位
B. 一般切开至黏膜下或皮下即可
C. 切口长度取决于脓肿部位的深浅与脓肿的大小
D. 应尽量选用口外引流
E. 颜面脓肿应顺皮纹方向切开

正确答案：D。应尽量选用口外引流

解析：切开引流的要求：①为达到按体位自然引流，切口位置应在脓腔的重力低位，以使引流道短、通畅、容易维持。②切口瘢痕隐蔽，切口长度取决于脓肿部位的深浅与脓肿的大小，以能保证引流通畅为准则；一般应尽力选用口内引流。颜面脓肿应顺皮纹方向切开，勿损伤重要解剖结构，如面神经、血管和唾液腺导管等。③一般切开至黏膜下或皮下即可，按脓肿位置用血管钳直达脓腔后再钝分离扩大创口；应避免在不同组织层次中形成多处假通道，以保证引流通畅。④手术操作应准确轻柔。颜面危险三角区的脓肿切开后，严禁挤压，以防感染扩散。掌握“口腔颌面部感染概论”知识点。